升浮性所示的功效是
A. 清热
B. 息风
C. 开窍
D. 消积
E. 潜阳

正确答案：C。开窍

解析：本题考查的是对升降沉浮的所示效用。升浮性所示的功效是开窍（C对）。升和浮、沉和降，都是相对的。升是上升，降是下降，浮表示发散向外，沉表示收敛固藏和泻利等。一般说，升浮类药能上行向外，分别具有升阳发表、祛风散寒、涌吐、开窍等作用；沉降类药能下行向内，分别具有泻下、清热（A错）、利水渗湿、重镇安神、潜阳（E错）息风（B错）、消积（D错）导滞、降逆止呕、收敛固涩、止咳平喘等作用。